延缓肠道碳水化合物吸收的药物是
A. 罗格列酮
B. 吡格列酮
C. 阿卡波糖
D. 格列齐特
E. 二甲双胍

正确答案：C。阿卡波糖

解析：阿卡波糖（C对）是α-葡萄糖苷酶抑制剂，其降血糖机制是：在小肠上皮刷状缘与碳水化合物竞争水解碳水化合物的糖苷水解酶，从而减慢碳水化合物水解及产生葡萄糖的速度并延缓葡萄糖的吸收。罗格列酮、吡格列酮是胰岛素增敏剂（AB错）（P354），改善B细胞功能，显著改善胰岛素抵抗及相关代谢紊乱，对2型糖尿病及其心血管并发症均有明显疗效。格列齐特（D错）（P352）是促进胰岛素分泌剂，通过刺激胰岛B细胞释放胰岛素而发挥降血糖作用。二甲双胍（E错）（P353）作用机制可能是促进脂肪组织摄取葡萄糖，降低葡萄糖在肠的吸收及糖原异生等而降低血糖。